甲氨蝶呤的抗肿瘤作用机制主要是抑制
A. DNA回旋酶
B. DNA多聚酶
C. 拓扑异构酶
D. 二氢叶酸合成酶
E. 二氢叶酸还原酶

正确答案：E。二氢叶酸还原酶